当一伸肌被过度牵拉时，张力会突然降低，其原因是
A. 疲劳
B. 负反馈
C. 回返性抑制
D. 腱器官兴奋
E. 肌梭敏感性降低

正确答案：D。腱器官兴奋